重症肌无力眼肌型的临床表现是
A. 眼裂正常，瞳孔扩大，直接对光反射迟钝
B. 眼裂扩大，瞳孔缩小，直接对光反射正常
C. 眼裂变小，瞳孔缩小，直接对光反射正常
D. 眼裂变小，瞳孔正常，直接对光反射正常
E. 眼裂变小，瞳孔扩大，直接对光反射消失

正确答案：D。眼裂变小，瞳孔正常，直接对光反射正常

解析：重症肌无力眼肌型病变仅限于眼外肌，临床表现为眼裂变小（AB错），瞳孔正常（D对）而不是缩小（C错），直接对光反射正常（AE错）。